男，65岁。间断左下肢疼痛3年，加重1个月。疼痛于较长时间行走后加重，休息后可好转。近1个月来休息后疼痛无好转，既往高血压、血脂异常病史15年。查体：T36.5℃，P80次／分，BP150/90mmHg，双肺呼吸音清，未闻及干湿性啰音，心律齐，A₂＞P₂。腹软，无压痛，左足苍白，左足及左下肢皮温明显降低，左股动脉可触及搏动，左腘动脉、足背动脉搏动消失。左下肢病变首先应考虑的诊断是
A. 动脉硬化性闭塞症
B. 深静脉血栓形成
C. 血栓性浅静脉炎
D. 急性动脉栓塞
E. 血栓闭塞性脉管炎

正确答案：A。动脉硬化性闭塞症

解析：患者老年男性，间断左下肢疼痛3年，加重1个月，疼痛于较长时间行走后加重，休息后可好转（间歇性跛行）。近1个月来休息后疼痛无好转（出现静息痛），既往高血压、血脂异常病史15年（动脉硬化性闭塞症高危因素，可致粥样硬化斑块形成继发动脉栓塞）。左足苍白、左足及左下肢皮温明显降低（动脉硬化性闭塞症后期可表现为病肢皮温明显降低、苍白），左腘动脉、足背动脉搏动消失（动脉硬化性闭塞症可表现为病肢的股、腘、胫后及足背动脉搏动减弱或不能扪及）。最可能的诊断为动脉硬化性闭塞症（A对）。血栓闭塞性脉管炎（E错）（P489）病肢出现感觉异常及疼痛，发病前或发病过程中出现复发性游走性浅静脉炎。急性动脉栓塞（D错）（P490）临床表现可概括为5P，即疼痛（pain）、感觉异常（paresthesia）、麻痹（paralysis）、无脉（pulselessness）和苍白（pallor）。深静脉血栓形成（B错）（P503）主要表现为患肢明显肿胀、疼痛及压痛。血栓性浅静脉炎（C错）（P501）常有浅静脉扩张、肿胀、皮炎及湿疹形成，可见局部硬结及皮肤粘连。